工矿企业健康促进工作开展的基础是
A. 政府、社区共同参与
B. 开展职业健康教育
C. 合理组织和安排劳动生产
D. 改变不良作业方式
E. 完善职业卫生服务

正确答案：B。开展职业健康教育